某一细胞群体杀伤肿瘤细胞机制为：①通过其Ag受体识别肿瘤细胞特异Ag，在Th辅助下直接杀伤肿瘤细胞；②该细胞活化后，分泌IFN-γ、TNF-β等细胞因子间接杀伤肿瘤细胞，该细胞是
A. MΦ
B. NK
C. CTL
D. LAK
E. TIL

正确答案：C。CTL